申请经营活动时应当具有冷藏设施设备和运输工具的药品是
A. 麻醉药品
B. 第一类精神药品
C. 第二类精神药品
D. 放射性药品
E. 第一类疫苗

正确答案：E。第一类疫苗

解析：本题考查疫苗全程冷链储运管理制度。申请经营活动时应当具有冷藏设施设备和运输工具的药品是第一类疫苗（E对）。《疫苗储存和运输管理规范（2017年版）》（国卫疾控发〔2017〕60号）规定，疾病预防控制机构、接种单位、疫苗生产企业、疫苗配送企业、疫苗仓储企业应当装备保障疫苗质量的储存、运输冷链设施设备。